五倍子不具有的功效是
A. 敛肺降火
B. 滋肾宁心
C. 涩肠固精
D. 收湿敛疮
E. 敛汗止血

正确答案：B。滋肾宁心

解析：本题考查五倍子的功效。五倍子不具有的功效是滋肾宁心（B错，为本题正确答案）。五倍子【功效】敛肺降火（A对），涩肠固精（C对），敛汗止血（E对），收湿敛疮（D对）。